均具有祛风湿强筋骨功效的药物是
A. 豨莶草
B. 防己
C. 威灵仙
D. 桑寄生
E. 蕲蛇

正确答案：D。桑寄生

解析：桑寄生的功效为祛风湿，补肝肾，强筋骨，安胎元（D对），本品苦燥甘补，既能祛风湿，又长于补肝肾、强筋骨。豨莶草的功效为祛风湿，利关节，解毒（A错）。防己的功效为祛风湿，止痛，利水消肿（B错）。威灵仙的功效为祛风湿，通经络，止痛，消骨骾（C错）。蕲蛇的功效为祛风，通络，止痉（E错）。